夏枯草除清肝火外，又能
A. 润肺燥
B. 散郁结
C. 退虚热
D. 利小便
E. 散风热

正确答案：B。散郁结

解析：本题考查夏枯草的功效。夏枯草除清肝火外，又能散郁结（B对）。夏枯草【功效】清肝明目，散结消肿。天花粉【功效】清热生津，清肺润燥（A错），消肿排脓。青蒿【功效】退虚热（C错），凉血，解暑，截疟。青风藤【功效】祛风湿，通经络，利小便（D错）。薄荷【功效】宣散风热（E错），清利头目，利咽，透疹，疏肝。